放射性同位素不得与易燃、易爆、腐蚀性物品同库储存属于
A. 放射诊疗场所防护要求
B. 放射治疗的原则和实施
C. 对患者和受检者的防护要求
D. 放射诊疗工作人员防护要求
E. 放射诊疗设备和检测仪表的要求

正确答案：A。放射诊疗场所防护要求

解析：放射性同位素不得与易燃、易爆、腐蚀性物品同库储存；储存场所应当采取有效的防泄漏等措施，并安装必要的报警装置。掌握“放射诊疗的防护与法律责任”知识点。